传染性非典型肺炎典型患者的首发症状是
A. 发热
B. 咳嗽
C. 呼吸困难
D. 腹泻
E. 鼻塞、流涕

正确答案：A。发热

解析：SARS的首发症状为发热（A对）；半数以上伴有头痛、肌肉关节头痛、乏力等症状，部分有咳嗽（B错）、胸痛、腹泻（D错）等，肺部体征不明显，少有呼吸道卡他症状。在进展期，发热及感染中毒症状持续存在，肺部病变进行性加重，表现为胸闷、气促、呼吸困难（C错），尤其在活动后明显。少见鼻塞、流涕（E错）。